患者，男，30岁，左下6（牙合）面隐裂累及牙髓，已完成根管治疗，左下6冠短，咬合紧，请设计最适宜的修复体
A. 高嵌体
B. 3/4冠
C. 邻（牙合）嵌体
D. 铸造全冠
E. 锤造全冠

正确答案：D。铸造全冠

解析：本题考查牙隐裂的修复治疗。铸造金属全冠耐磨性，抗力性较好且去除牙体组织少，为最适宜的修复设计（D对）。后牙隐裂，经过牙髓治疗无症状，牙体组织抗力较差，因此不适合高嵌体（A错）和邻（牙合）嵌体（C错）修复。患牙临床冠短，咬合紧，无法获得较大的修复空间，3/4冠修复无法获得可靠的固位力，易脱落（B错），且患牙位置靠后，对美观要求不高。锤造全冠（E错）是应用合金片经冲压而成的壳状全冠修复体，虽然牙体预备切割量较铸造全冠少，但是其密合度、固位力、机械强度、外形修复、咬合和邻接关系都比铸造全冠差，临床已较少使用，因此本题最适宜的修复体为铸造全冠。